容易混淆的药品中文名
A. 阿拉明与可拉明
B. 安妥明与安妥碘
C. 消心痛与消炎痛
D. 他巴唑与地巴唑
E. 泰能与泰宁

正确答案：A、B、C、D、E。阿拉明与可拉明；安妥明与安妥碘；消心痛与消炎痛；他巴唑与地巴唑；泰能与泰宁

解析：本题考查容易混淆的中文名。容易混淆的药品中文名：阿拉明与可拉明（A对）、安妥明与安妥碘（B对）、消心痛与消炎痛（C对）、他巴唑与地巴唑（D对）、泰能与泰宁（E对）。阿拉明是抗休克的血管活性药；可拉明是中枢神经兴奋药。安妥明是调节血脂药；安妥碘是眼科用药。消心痛是抗心绞痛药；消炎痛是非甾体抗炎药。他巴唑是抗甲状腺药；地巴唑是抗高血压药。泰能是抗菌药；泰宁是抗帕金森病药。